关于淋巴结，何者为错
A. 数目较多，常聚集成群
B. 常位于身体较隐蔽处
C. 是淋巴器官的一个组成部分
D. 输出管数目少于输入管
E. 淋巴输出管与具凸侧相连

正确答案：E。淋巴输出管与具凸侧相连

解析：淋巴结数目较多，常聚集成群（A对）。常位于身体较隐蔽处（B对）。是淋巴器官的一个组成部分（C对）。输出管数目少于输入管（D对）。淋巴输入管（E错，为本题正确答案）与具凸侧相连。